牙龈因失去食物按摩废用萎缩是由于
A. 牙冠轴面凸度过大
B. 牙冠轴面凸度过小
C. 牙冠轴面无凸度
D. 牙冠（牙合）外展隙不明显
E. 牙冠（牙合）面副沟排溢道不明显

正确答案：A。牙冠轴面凸度过大

解析：本题考查乳恒牙鉴别及牙体形态的生理意义。牙冠唇（颊）、舌面突度的生理意义：咀嚼时，排溢的食物顺着正常的牙冠突度滑至口腔，擦过牙龈表面时对牙龈起按摩作用，可促进血液循环，有利于牙龈的健康。若牙冠突度过小或无突度（BC错），牙龈将会受食物直接撞击而受伤；反之，若牙冠突度过大（A对），牙龈会失去食物对其的按摩作用，可能产生废用性萎缩。牙冠颈1/3的突度，还可起到扩展龈缘的作用，使其紧张而有力。